可延长滴眼剂中药物与角膜作用时间，有利于药物吸收的附加剂是
A. 渗透压调节剂
B. 助溶剂
C. 抑菌剂
D. 黏度调节剂
E. 增溶剂

正确答案：D。黏度调节剂

解析：本题考查眼用制剂的常用附加剂。黏度调节剂（D对）适当增加滴眼剂的黏度，可减少刺激性，延缓混悬型眼用制剂的沉降、延长药液在眼内滞留时间，增强药效。常用的黏度调节剂有甲基纤维素、聚乙烯醇、聚维酮等。渗透压调节（A错）剂除另有规定外，水溶性滴眼剂、洗眼剂和眼用注射溶液应与泪液等渗。洗眼剂属于用量较大的眼用制剂，也应尽可能与泪液等渗。常用渗透压调节剂有氯化钠、硼酸、葡萄糖、硼砂等。渗透压调节剂用量的计算方法与注射剂相同。助溶剂（B错）难溶性药物与加入的第三种物质在溶剂中形成可溶性分子间络合物、缔合物或复盐等，以增加药物在溶剂中的溶解度。这第三种物质称为助溶剂。抑菌剂（C错）多剂量眼用制剂，应加适当抑菌剂。常用的抑菌剂有三氯叔丁醇、硝酸苯汞、苯乙醇、羟苯乙酯等。增溶剂（E错）增溶是指难溶性药物在表面活性剂形成的胶团作用下，在溶剂中溶解度增加并形成溶液的过程。具有增溶作用的表面活性剂称为增溶剂。